伤寒发病几周后可见肥达反应阳性
A. 第1周
B. 第2周
C. 第3周
D. 第4周
E. 第5周

正确答案：B。第2周

解析：本题考查肥达试验。伤寒发病2周（B对ACDE错）后可见肥达反应阳性。肥达试验是诊断伤寒、副伤寒的辅助诊断。机体患伤寒、副伤寒，一般于发病后1-2周内血液中出现特异性抗体并且随着病程延长而效价渐升，此时即可为阳性，第4周可达峰值，以后又逐渐降低。